如遇一位异种动物血清过敏者（仍需注破伤风抗毒素）应当如何处理
A. 停止注射
B. 用脱敏药后再注射
C. 少量多次注射
D. 一次性皮下注射
E. 与减敏药物同时注射

正确答案：C。少量多次注射

解析：对必须使用异种免疫血清而又过敏者，可短间隔（20～30分钟）小剂量多次注射抗血清，使体内致敏细胞分期分批小量脱颗粒释放介质，解除致敏状态。掌握“概述及Ⅰ型超敏反应”知识点。